女，28岁，于妊娠早期有早孕反应，尿HCG阳性。于妊娠17周时感有胎动。B超示单胎，头位，见心脏搏动。现为妊娠26周，近2周来自觉胎动停止，腹部不再增大，来门诊检查，宫底平脐，未闻及胎心，复查B超未见胎心搏动和胎动，临床诊断是
A. 过期流产
B. 习惯性流产
C. 死胎
D. 死产
E. 葡萄胎

正确答案：C。死胎

解析：患者妊娠早期有早孕反应，尿HCG阳性，妊娠17周时感有胎动，B超示单胎，头位，见心脏搏动，现为妊娠26周（>20周），近2周来自觉胎动停止，腹部不再增大，来门诊检查，宫底平脐（提示子宫大小小于妊娠周数），未闻及胎心，复查B超未见胎心搏动和胎动（提示胎儿死亡），根据患者的临床症状、体征及B超检查，考虑临床诊断是死胎（C对），死胎是指妊娠20周后胎儿在子宫内死亡。流产（AB错）多伴有阴道流血及腹痛的症状，该患者并不存在这些症状。死产（D错）是指胎儿在分娩过程中死亡。葡萄胎（E错）B超检查看不到胎儿及胎心搏动。